主要用于倒凹区在支托的同侧下方的基牙
A. 锻丝卡环
B. 圈形卡环
C. 三臂卡环
D. 下返卡环
E. 单臂卡环

正确答案：D。下返卡环

解析：倒钩卡环：用于倒凹区在支托的同侧下方的基牙，又称下返卡环。掌握“局部义齿固位体”知识点。